某男，8岁，每晚遗尿，面白神疲，形体瘦小，舌淡嫩苔少，脉弱。临床诊断最可能是
A. 肾阳虚证
B. 肾阴虚证
C. 肾气不固证
D. 肾不纳气证
E. 肾精不足证

正确答案：C。肾气不固证

解析：肾气不固证以腰膝酸软，小便、精液、经带、胎气不固与气虚症状共见为辨证的依据。腰为肾之府，肾主骨生髓。肾气不充身，则神疲乏力；肾气亏虚，固摄无权，膀胱失约，则小便频数，尿后余沥不尽，遗尿，夜尿多，甚则尿失禁；舌淡脉弱为肾气虚弱之象（C对）。